复合树脂充填V类洞，以下设计正确的是
A. 小缺损及中等缺损设计应尽量保守
B. 仅在釉质壁做斜面
C. 范围大的缺损应预备固位形
D. 固位形的设计可为固位沟
E. 以上都正确

正确答案：E。以上都正确

解析：本题考查V类洞预备要点。由于Ⅴ类洞位于颈1/3处，常累及根面，涉及釉质、牙本质和牙骨质，因此预备时应根据不同情况分别进行处理。小缺损及中等缺损设计应尽量保守（A对），尽量少磨除牙体组织，此时缺损位于釉质内，只需将洞壁磨粗糙，在釉质洞缘预备斜面即可（B对）。范围大的缺损仅靠树脂的粘结力及侧壁无法获得足够的固位，应预备固位沟以增加固位（CD对）。（ABCD均对，故E为本题的正确答案）。